上颌骨骨折X线检查首选
A. 华特位片
B. 铁氏位片
C. 颏顶位片
D. 许勒位片
E. 颧弓位片

正确答案：A。华特位片

解析：本题考查华特位片。华特位片（A对）又称鼻颏位片，常用于检查上颌骨骨折情况，可清楚显示上颌骨、上颌窦、鼻窦的情况。铁氏位片（B错）又称颧骨后前位片，常用于检查颧骨骨折情况。颏顶位片（C错）又称颅底位片，常用于检查颅底、上颌后部及颞下窝病变。许勒位片（D错）又称颞下颌关节经颅侧斜位片，常用于检查颞下颌关节骨质和功能性病变。颧弓位片（E错）常用于检查颧骨、颧弓骨折情况。